不是中和抗体的作用机制是
A. 阻止病毒吸附于易感细胞
B. 与病毒形成免疫复合物易被吞噬
C. 阻止无包膜病毒脱壳
D. 与病毒表面抗原结合，激活补体，使细胞溶解
E. 活化杀伤T细胞（CTL）释放淋巴因子

正确答案：E。活化杀伤T细胞（CTL）释放淋巴因子

解析：中和抗体可直接封闭与细胞受体结合的病毒抗原表位，或改变病毒表面构型，阻止病毒吸附于易感细胞，使病毒不能穿入细胞内进行增殖；病毒与中和抗体形成的免疫复合物，易被巨噬细胞吞噬清除；包膜病毒的表面抗原与中和抗体结合后，可通过激活补体导致病毒裂解。掌握“病毒传播方式、感染类型、致病机制及免疫”知识点。